结构中含有手性碳原子，其左旋异构体已上市的H₁受体拮抗剂是
A. 氯雷他定
B. 富马酸酮替芬
C. 盐酸苯海拉明
D. 盐酸西替利嗪
E. 盐酸赛庚啶

正确答案：D。盐酸西替利嗪

解析：本题考查H₁受体拮抗剂的作用特点。盐酸西替利嗪（D对）结构中含有一个手性中心，具有旋光性，左旋体活性比右旋体活性更强。其 R-（-）异构体左西替利嗪现已上市。